按照突发事件的严重性、紧急程度和可能波及的范围，突发环境污染事件的预警系统由高到低分为Ⅰ、Ⅱ、Ⅲ、Ⅳ级，其颜色应依次为
A. 红色、蓝色、黄色、橙色
B. 蓝色、黄色、橙色、红色
C. 橙色、红色、蓝色、黄色
D. 黄色、橙色、红色、蓝色
E. 红色、橙色、黄色、蓝色

正确答案：E。红色、橙色、黄色、蓝色

解析：本题考查突发环境污染事件的应急处理。根据突发环境事件的严重程度和发展态势，将应急响应设定为Ⅰ级、Ⅱ级、Ⅲ级和Ⅳ级四个等级，其颜色应依次为红色、橙色、黄色、蓝色（E对ABCD错）。